响度级的测定是以（）㎐的纯音作为基准音
A. 100
B. 1000
C. 2000
D. 4000

正确答案：B。1000

解析：本题考查响度级的测定。响度级是经过大量严格的实验测试得出来的。具体方法是：以1000㎐（B对ACD错）的纯音作为基准音，其他不同频率的纯音通过实验听起来与某一声压级的基准音响度相同时，即为等响。该条件下的被测纯音响度级就等于基准音的声压级（dB值）。